患者，男，34岁。腰膝疫软，头目眩晕，耳鸣耳聋，盗汗遗精，口燥咽干，舌红少苔，脉细数。治疗应首选
A. 大补阴丸
B. 六味地黄丸
C. 肾气丸
D. 地黄饮子
E. 右归丸

正确答案：B。六味地黄丸

解析：患者腰膝疫软，头目眩晕，耳鸣耳聋，盗汗遗精，口燥咽干，舌红少苔，脉细数。方用六味地黄丸，为治疗肝肾阴虚的基础方。熟地黄滋阴补肾，填精益髓；山茱萸补养肝肾，涩精；山药补益脾阴，固肾，泽泻利湿而泄肾浊；丹参泄肾浊（B对）。大补阴丸证由肝肾亏虚，真阴不足，虚火上炎所致。为治疗阴虚火旺证的基础方（A错）。肾气丸主治肾阳不足证（C错）。地黄饮子为治疗肾虚喑痱的常用方（D错）。右归丸为治疗肾阳不足，命门火衰的常用方（E错）。